蛋白质四级结构形成时出现
A. 构象改变
B. 亚基聚合
C. 肽键断裂
D. 二硫键形成
E. 蛋白质聚集

正确答案：B。亚基聚合